下列哪种情况不是预防性消毒
A. 饮水加氯
B. 食物煮沸
C. 公共场所空气消毒
D. 对痢疾患者每次所排粪便的消毒

正确答案：D。对痢疾患者每次所排粪便的消毒

解析：本题考查预防性消毒。预防性消毒是指在没有发现明确传染源的情况下，对可能被传染病病原体污染的场所和物品进行消毒。如饮水加氯消毒（A对）、食物煮沸消毒（B对）、公共场所空气消毒（C对）等。对痢疾患者每次所排粪便进行消毒（D错，为本题正确答案）属于疫源地消毒中的随时消毒。